麦芽不具有的功效是
A. 消食
B. 降气
C. 疏肝
D. 和中
E. 回乳

正确答案：B。降气

解析：本题考查的是麦芽的功效。麦芽不具有的功效是降气（B错，为本题正确答案）。麦芽：【功效】消食（A对）和中（D对），回乳（E对），疏肝（C对）。降气为莱菔子的功效。莱菔子：【功效】消食除胀，降气化痰。